朱砂的主要成分是
A. 二硫化二砷
B. 二硫化铁
C. 硫酸锌
D. 三氧化二砷
E. 硫化汞

正确答案：E。硫化汞

解析：本题考查的是矿物类中药的成分鉴别。朱砂的主成分是硫化汞（E对）。朱砂：【来源】为硫化物类矿物辰砂族辰砂。主含硫化汞（HgS）。二硫化二砷（A错）是雄黄的主成分。雄黄：【来源】为硫化物类矿物雄黄族雄黄。主含二硫化二砷（As₂S₂）。二硫化铁（B错）是自然铜的主成分。自然铜：【来源】为硫化物类矿物黄铁矿族黄铁矿。主含二硫化铁（FeS₂）。三氧化二砷（D错）是砒石的主成分。含硫酸锌（C错）的中药，2022年考试指南未明确说明。